对异物吸入的小儿应
A. 嘱小儿蹦跳，将异物咳出
B. 刺激咽喉部，将异物咳出
C. 观察，必要时送往医院
D. 拍背，帮助孩子咳出异物
E. 立即送往医院

正确答案：E。立即送往医院

解析：本题考查异物损伤的预防及急救处理。当异物进入儿童气管、支气管或其深部时，会引起患儿呛咳、面部青紫、呼吸困难等，情况会比较危急，应立即送往医院（E对ABCD错），如果不及时采取急救措施，可能会引起窒息而死亡。